某女，24岁。症见食量不多、气虚痰多、腹胀便溏。证属脾胃虚弱，宜选用的成药是
A. 启脾丸
B. 四君子丸
C. 补中益气丸
D. 六君子丸
E. 香砂六君丸

正确答案：D。六君子丸

解析：本题考查的是六君子丸的主治。症见食量不多、气虚痰多、腹胀便溏。证属脾胃虚弱，宜选用的成药是六君子丸（D对）。六君子丸：【主治】脾胃虚弱，食量不多，气虚痰多，腹胀便溏。启脾丸（A错）：【主治】脾胃虚弱，消化不良，腹胀便溏。四君子丸（B错）：【主治】脾胃气虚，胃纳不佳，食少便溏。补中益气丸（C错）：【主治】脾胃虚弱、中气下陷所致的泄泻、脱肛、阴挺，症见体倦乏力、食少腹胀、便溏久泻、肛门下坠或脱肛、子宫脱垂。香砂六君丸（E错）：【主治】脾虚气滞，消化不良，嗳气食少，脘腹胀满，大便溏泄。